乳痈初起，证属肝气不舒，胃热壅滞。治疗应首选
A. 逍遥散
B. 透脓散
C. 四妙汤
D. 瓜蒌牛蒡汤
E. 牛蒡解肌汤

正确答案：D。瓜蒌牛蒡汤

解析：乳痈证属肝气不舒，胃热壅滞者多因情志不畅，肝气郁结，失于疏泄；或产后饮食不节，脾胃运化失司，阳明胃热壅滞，使乳络闭阻不畅，郁而化热，形成乳痈。治宜疏肝清胃，通乳消肿。方用瓜蒌牛蒡汤加减（D对）。逍遥散功擅疏肝解郁，可用于乳核之肝气郁结证（A错）。透脓散功擅清热解毒，托里透脓，可用乳痈之热毒炽盛证（B错）。四妙汤功能清热渗湿，合补阳还五汤可用于臁疮之气虚血瘀证（C错）。牛蒡解肌汤功能疏风清热化痰，可用于瘿痈之风热痰凝证（E错）。